位于下颌后弓区，由近中的颊系带、远中的磨牙后垫和远中颊角区、外侧的下颌骨外斜嵴和内侧的牙槽嵴所围成的区域
A. 切牙乳突
B. 上颌结节
C. 腭小凹
D. 颊棚区
E. 磨牙后垫

正确答案：D。颊棚区

解析：本题考查种植覆盖全口义齿。颊棚区（D对）位于下颌后弓区，由近中的颊系带、远中的磨牙后垫和远中颊角区、外侧的下颌骨外斜嵴和内侧的牙槽嵴所围成的区域。由于其表面骨皮质厚、致密，因此能够承受较大的咀嚼压力。